小儿第三个生理弯曲出现是在
A. 3个月
B. 6个月
C. 9个月
D. 12个月
E. 6～7岁

正确答案：D。12个月

解析：1岁小儿站立行走时出现腰椎前凸（第三个生理弯曲）。掌握“骨骼发育”知识点。